下列对闭合性单根肋骨骨折的处理正确的是
A. 不锈钢丝固定
B. 胸壁加压包扎固定
C. 输血治疗
D. 气管插管
E. 开胸探查

正确答案：B。胸壁加压包扎固定

解析：闭合性单根肋骨骨折的处理正确的是胸壁加压包扎固定（B对），以减少肋骨断端活动、减轻疼痛。不锈钢丝固定（A错）和气管插管（D错）主要用于闭合性多根多处肋骨骨折及开放性骨折的治疗措施。闭合性单根肋骨骨折断端因有上下完整的肋骨和肋间肌支撑，较少有肋骨断端错位、活动和重叠，故一般很少引起大量失血，无需输血治疗（C错）。开胸探查（E错）适用于进行性血胸、心脏大血管损伤等胸部严重损伤。